男，55岁。咳嗽伴痰中带血2周，胸部X线片及CT检查发现右肺上叶周围型结节，痰细胞学检查示：燕麦细胞癌。该患者诊断是
A. 鳞癌
B. 腺癌
C. 类癌
D. 大细胞癌
E. 小细胞癌

正确答案：E。小细胞癌

解析：小细胞癌是肺癌中分化最低、恶性度最高的一种。镜下，癌细胞小，常呈圆形或卵圆形，似淋巴细胞，但体积较大：也可呈梭形或燕麦形，胞质少，似裸核，癌细胞呈弥漫分布或呈片状条索状排列，称燕麦细胞癌（E对）。